哌替啶不用于慢性钝痛的最主要原因是
A. 维持时间短
B. 镇痛效果弱于吗啡
C. 抑制呼吸
D. 有成瘾性
E. 易引起心血管反应

正确答案：D。有成瘾性

解析：长期反复应用也易产生耐受性和成瘾性；过量亦明显抑制呼吸，故哌替啶不用于慢性钝痛（D对）。